肝功能减退时，可选用的抗菌药物是
A. 四环素类
B. 氯霉素
C. 利福平
D. 氨基糖苷类
E. 磺胺类

正确答案：D。氨基糖苷类

解析：本题考查特殊人群用药。肝功能减退时，可选用的抗菌药物是氨基糖苷类（D对）。抗菌药主要由肾排泄，无明显肝毒性的抗菌药物有：青霉素、头孢唑林、头孢他啶、氨基糖苷类（庆大霉素、妥布霉素、阿米卡星等）、多黏菌素类、万古霉素、单环菌素类、碳青霉烯类。